下列各项，不是甲亢手术并发症的是
A. 呼吸困难和窒息
B. 声音嘶哑
C. 呛咳
D. 甲状腺危象
E. 吞咽困难

正确答案：E。吞咽困难

解析：甲亢手术常见并发症：1.术后呼吸困难和窒息（A错）。2.喉返神经损伤：一侧喉返神经损伤可引起声音嘶哑（B错），双侧喉返神经损伤可导致失音或严重的呼吸困难，甚至窒息。3.喉上神经损伤：若损伤外支会使环甲肌瘫痪，引起声带松弛，音调降低，说话费力。内支损伤则喉部黏膜感觉丧失，进食特别是饮水时容易误咽发生呛咳（C错）。4.手足抽搐。5.甲状腺危象（D错）。6.甲状腺功能减退（E错，为本题正确答案）。